糖酵解途径中的关键酶是
A. 果糖二磷酸酶-1
B. 6-磷酸果糖激酶-1
C. HMG-CoA还原酶
D. 磷酸化酶
E. HMG-CoA合成酶

正确答案：B。6-磷酸果糖激酶-1

解析：糖酵解途径指的是从葡萄糖到丙酮酸的过程，其中的关键酶包括：己糖激酶、6-磷酸果糖激酶（B对）和丙酮酸激酶。果糖二磷酸酶-1（A错）是糖异生过程中的关键酶。磷酸化酶（D错）是指将供体的磷酸基团转移到受体上的一类酶，例如糖原磷酸化酶是糖原分解过程中的关键酶。HMG-CoA还原酶（C错）是胆固醇合成的关键酶。HMG-CoA合成酶（E错）在酮体及胆固醇的合成中均有用到，但它并不是关键酶。